对于临床预防服务的具体内容，说法错误的是
A. 提供者是临床医务人员
B. 服务的地点是在临床场所
C. 服务对象是有症状患者
D. 服务的内容强调一、二级预防结合
E. 是临床与预防一体化的卫生服务

正确答案：C。服务对象是有症状患者

解析：临床预防服务的提供者是临床医务人员，服务的地点是在临床场所，服务对象是健康和无症状“患者”个体，服务的内容强调第一级和第二级预防的结合，以及预防性治疗，且是临床与预防一体化的卫生服务。掌握“临床预防服务概述”知识点。